心脏听诊，听到“大炮音”应考虑
A. 二尖瓣狭窄
B. P-R间期缩短
C. 运动或发热
D. 完全性房室传导阻滞
E. 甲状腺功能亢进

正确答案：D。完全性房室传导阻滞

解析：大炮音常见于完全性房室传导阻滞（D对）。完全性房室传导阻滞时，当心室收缩正好即刻出现在心房收缩之后，心室在相对未完全舒张和未被血液充分充盈的情况下，二尖瓣位置较低，急速的心室收缩使二尖瓣迅速和有力地关闭使第一心音增强，称其为“大炮音”。二尖瓣狭窄（A错）和PR间期缩短（B错）时，心室充盈减少减慢，二尖瓣位置较低，可产生S₁增强；运动或发热（C错）和甲状腺功能亢进（E错）时，心肌收缩力增强、心动过速也可使S₁增强，但在心脏听诊时，都不听到“大炮音”。